女，23岁。1个月前分娩后出现失眠、心情烦躁，近2周加重，认为自己很笨，没有能力带好小孩，怕小孩夭折，觉得丈夫不再喜欢自己了，猜疑丈夫有外遇，整日以泪洗面，称不想活了，甚至要带孩子一起去死，遂入院治疗。患者经治疗后，情况逐渐好转，近1周显兴奋，容易激动，好管闲事，自我感觉良好，称将来要成为中国女首富，丈夫根本配不上自己，目前最可能的诊断是
A. 产后抑郁症
B. 妄想性障碍
C. 环形心境障碍
D. 双相障碍，躁狂发作
E. 精神分裂症

正确答案：D。双相障碍，躁狂发作

解析：躁狂发作的典型临床表现是情感高涨、思维奔逸、活动增多“三高”症状，可伴有夸大观念或妄想、冲动行为等。发作应至少持续1周，并有不同程度的社会功能损害，可给自己或他人造成危险或不良后果。躁狂可一生仅发作一次，也可反复发作。患者治疗前为抑郁发作的典型表现，经治疗后出现躁狂发作的典型临床表现，符合双相障碍（D对）。